决定尿量多少最关键的部位是
A. 肾小囊
B. 近曲小管
C. 髓袢升支
D. 髓袢降支
E. 远曲小管和集合管

正确答案：E。远曲小管和集合管